面神经核下瘫出现
A. 对侧鼻唇沟变浅或消失
B. 伸舌舌尖偏向病灶的对侧
C. 同侧异唇沟变浅或消失
D. 伸舌舌尖偏向病灶同侧
E. 无

正确答案：C。同侧异唇沟变浅或消失

解析：面神经核下瘫表现为病灶侧所有的面肌瘫痪，表现为额横纹消失，眼不能闭，口角下垂并歪向健侧，同侧异唇沟变浅或消失（C对A错），其舍肌并不瘫痪，因此伸舌时舌尖不偏（BD错）。